女，28岁，间歇性牙龈出血1年。体检：双下肢可见散在出血点及紫斑，肝脾不大，余无异常。血红蛋白110g/L，红细胞42×1012/L，白细胞60×109/L，分类正常，血小板28×109/L。若骨髓穿刺结果示骨髓细胞增生活跃。粒：红=3：1，颗粒巨及以上巨核细胞明显增生而产板巨明显减少，则明确的诊断是
A. 脾功能亢进
B. 过敏性紫癜
C. 急性白血病
D. 特发性血小板减少性紫癜
E. 再生障碍性贫血

正确答案：D。特发性血小板减少性紫癜

解析：特发性血小板减少性紫癜诊断要点：至少2次化验血小板计数减少，血细胞形态无异常；体检脾脏一般不增大；骨髓检查巨核细胞数量正常或增多，有成熟障碍。掌握“特发性血小板减少性紫癜（ITP）”知识点。